胰岛素不会引起
A. 过敏反应
B. 低血糖
C. 脂肪萎缩
D. 酮血症
E. 胰岛素抵抗

正确答案：D。酮血症

解析：本题考查胰岛素的不良反应。胰岛素不会引起酮血症（D错，为本题正确答案）。酮血症是患糖尿病时，糖类物质利用受阻或长期不能进食，机体所需能量不能从糖的氧化取得，于是大量动用脂肪提供能量，脂肪酸大量氧化，生成酮体超过了肝外组织所利用的限度，导致血液中酮体堆积，造成酮血症。胰岛素不良反应有过敏反应（A对）、低血糖（B对）、注射部位皮下脂肪萎缩（C对）或肥厚、胰岛素抵抗（E对）等。